用于产后子宫复原的是
A. 甲睾酮
B. 甲羟孕酮
C. 他莫昔芬
D. 麦角生物碱
E. 缩宫素

正确答案：D。麦角生物碱

解析：本题考查麦角生物碱的临床应用。麦角生物碱（D对）临床用于子宫出血、产后子宫复旧、偏头痛、中枢抑制。